具有神经毒的毒蛇是
A. 眼镜蛇
B. 蝮蛇
C. 竹叶青蛇
D. 银环蛇
E. 烙铁头蛇

正确答案：D。银环蛇

解析：目前已知我国的蛇类约219种，其中毒蛇50余种，但对人体构成较大威胁的有10种。神经毒者有银环蛇（D对）、金环蛇、海蛇；血循毒者有蝰蛇、尖吻蝮蛇、竹叶青蛇（C错）和烙铁头蛇（E错）；混合毒者有眼镜蛇（A错）、眼镜王蛇和蝮蛇（B错）。